某男，40岁。近2月来，心神烦乱、失眠多梦、心悸不宁，舌尖红，脉细数，医师诊后认为，其病乃因心火亢盛、阴血不足所致。宜选用的成药是
A. 枣仁安神液
B. 养血安神丸
C. 朱砂安神丸
D. 柏子养心丸
E. 天王补心丸

正确答案：C。朱砂安神丸

解析：本题考查的是朱砂安神丸的主治。近2月来，心神烦乱、失眠多梦、心悸不宁，舌尖红，脉细数，医师诊后认为，其病乃因心火亢盛、阴血不足所致。宜选用的成药是朱砂安神丸（C对）。朱砂安神丸：【主治】心火亢盛、阴血不足证，症见心神烦乱、失眠多梦、心悸不宁、舌尖红、脉细数。枣仁安神液（A错）：【主治】心血不足所致的失眠、健忘、心烦、头晕；神经衰弱症见上述证候者。养血安神丸（B错）：【主治】阴虚血少所致的头眩心悸、失眠健忘。柏子养心丸（D错）：【主治】心气虚寒，心悸易惊，失眠多梦，健忘。天王补心丸（E错）：【主治】心阴不足，心悸健忘，失眠多梦，大便干燥。